下列关于食品生产许可实行的原则，正确的是
A. 一地多证
B. 一县一证
C. 一企多证
D. 一企一证
E. 多企一证

正确答案：D。一企一证